男，49岁。发作劳力性胸痛2月余，每次持续5～10分钟，休息2～3分钟可自行缓解。查体：BP140/90mmHg，心率110次/分，律齐。心电图示窦性心律。为控制心率宜首选的药物是
A. 地高辛
B. 胺碘酮
C. 普罗帕酮
D. 维拉帕米
E. 美托洛尔

正确答案：E。美托洛尔

解析：患者中年男性，发作劳力性胸痛，每次持续5～10分钟，休息2～3分钟可自行缓解（典型的心绞痛临床特点），考虑诊断为稳定型心绞痛。美托洛尔为选择性的β1受体拮抗药，可降低窦性心率，降低心肌耗氧量、改善心肌缺血、减少心绞痛发作，而且长期应用可显著降低死亡等心血管事件（P225），故患者控制心率宜首选的药物是美托洛尔（E对）。地高辛（P172）（A错）为洋地黄制剂，主要用于慢性心衰的强心治疗。胺碘酮（B错）和普罗帕酮（C错）同为广谱抗心律失常药物（具体适应证可参考P206），可用于室上性和室性心律失常，一般不用于心绞痛患者控制心室率。维拉帕米（P225）（D错）为非二氢吡啶类钙通道拮抗剂，可抑制心肌收缩，减少心肌耗氧，扩张冠脉，改善心内膜下心肌的供血，多用于合并高血压的心绞痛患者抗缺血治疗。但维拉帕米对改善患者的预后效果不如美托洛尔，故并非本题最佳答案。